DNA的一级结构是
A. 多聚A结构
B. 核小体结构
C. 双螺旋结构
D. 三叶草结构
E. 多核苷酸排列顺序

正确答案：E。多核苷酸排列顺序

解析：DNA的一级结构是多核苷酸排列顺序（E对），即构成DNA的脱氧核苷酸自5＇-端至3＇-端的排列顺序。双螺旋结构（C错）是DNA的二级结构。核小体结构（P45）（B错）是染色质的基本组成单位，是DNA的高级结构。多聚A结构（A错）是真核生物mRNA3＇-端的多聚腺苷酸尾。三叶草结构（D错）是tRNA的二级结构。